在全身毒作用中常见的靶器官不包括
A. 神经系统
B. 造血系统
C. 脑
D. 肝

正确答案：C。脑

解析：本题考查全身毒作用中常见的靶器官。外源化学物直接或主要损害的器官称为该物质的靶器官。在全身毒作用中常见的靶器官有神经系统（A对）、血液和造血系统（B对）、生殖系统以及肝（D对）、肾、肺等。脑（C错，为本题正确答案）不是常见的靶器官。